小儿尿路感染慢性期，脾肾气虚证的治法是
A. 滋阴补肾
B. 健脾益气
C. 活血化瘀
D. 泻火解毒，清利肝胆
E. 健脾补肾，佐以渗湿

正确答案：E。健脾补肾，佐以渗湿

解析：小儿尿路感染慢性期，脾肾气虚证是由于脾虚运化失常，肾虚气化不利所致，治疗时应健脾补肾，佐以渗湿（E对）